根治术后5年生存率为65%的是
A. 脾曲结肠癌，DukesC期
B. 乙状结肠癌，DukesA1期
C. 横结肠癌，DukesA2期
D. 乙状结肠癌，DukesD期
E. 降结肠癌，DukesB期

正确答案：E。降结肠癌，DukesB期

解析：结肠癌的预后较好，经根治手术治疗后，DukesA、B及C期的5年生存率分别可达80%、65%及30%。降结肠癌属于结肠癌，经根治手术治疗后，Duks B期的5年生存率为65％（E对）。